急性下壁心肌梗死时血清CK-MB浓度的典型变化为发病后
A. 6～12小时达高峰
B. 13～15小时达高峰
C. 16～24小时达高峰
D. 25～35小时达高峰
E. 36～48小时达高峰

正确答案：C。16～24小时达高峰

解析：急性心肌梗死时血清CK-MB浓度的典型变化为在起病后4小时内升高，16～24小时达高峰（C对ABDE错），3～4天恢复正常。